某女，36岁。患湿热痹痛2年，近日新患湿热黄疸，宜选用的药是
A. 秦艽
B. 川乌
C. 络石藤
D. 伸筋草
E. 香加皮

正确答案：A。秦艽

解析：本题考查的是秦艽的主治病证。患湿热痹痛2年，近日新患湿热黄疸，宜选用的药是秦艽（A对）。秦艽：【主治病证】（1）风湿热痹，风寒湿痹，表证夹湿。（2）骨蒸潮热。（3）湿热黄疸。川乌（B错）：【主治病证】（1）风寒湿痹，寒湿头痛。（2）心腹冷痛，寒疝腹痛。（3）局部麻醉（外用）。络石藤（C错）：【主治病证】（1）风湿痹痛，筋脉拘挛。（2）喉痹，痈肿。伸筋草（D错）：【主治病证】（1）风湿痹痛，关节酸痛，屈伸不利。（2）跌打损伤。香加皮（E错）：【主治病证】（1）风寒湿痹，腰膝酸软。（2）水肿（尤宜心衰性水肿），小便不利。